阿司匹林用于心血管事件一级预防之前，应将血压控制在
A. 155/105mmHg以下
B. 150/100mmHg以下
C. 145/95mmHg以下
D. 140/95mmHg以下
E. 135/85mmHg以下

正确答案：E。135/85mmHg以下

解析：本题考查阿司匹林的应用。对采用阿司匹林进行心血管事性一级预防前，应严格控制血压在140/90mmHg以下（E对），否则可致患者大出血。